孕期营养不良对胎儿的影响不包括
A. 低出生体重
B. 脑发育受损
C. 畸形儿
D. 佝偻病
E. 小于胎龄儿

正确答案：D。佝偻病